慢性肾功能不全出现肾性贫血最合适的治疗药物是
A. 口服碳酸钙
B. 必需氨基酸疗法
C. 补充1，25-（OH）₂D₃
D. 促红细胞生成素
E. 血液透析治疗

正确答案：D。促红细胞生成素

解析：慢性肾功能不全出现肾性贫血，主要是由于肾组织分泌促红细胞生成素（EPO）减少，故最合适的治疗药物是促红细胞生成素（D对）。碳酸钙为磷结合剂，口服碳酸钙（A错）主要用于降低血磷。必需氨基酸疗法（B错）作为基础疗法，主要用于改善患者的营养状态、减轻氮质血症。补充1，25-（OH）₂D₃（C错）主要用于纠正低钙血症。血液透析治疗（E错）是慢性肾功能不全伴高钾血症患者最可行有效的治疗措施。